40岁，女性，三年来劳累后气促，曾诊为哮喘，X光片示前上纵隔类圆阴影压迫气管，最可能的诊断
A. 淋巴瘤
B. 神经源性肿瘤
C. 肺癌
D. 胸骨后甲状腺肿
E. 心包囊肿

正确答案：D。胸骨后甲状腺肿

解析：临床上以胸骨角与第四胸椎下缘的水平线为界，将纵隔分为上、下两部。下纵隔再以心包前后界分为前、中、后三部分。前上纵隔类圆形阴影可能为胸腺瘤或胸骨后甲状腺肿。该患者女性，类圆形肿物压迫气管，故最可能的诊断为胸骨后甲状腺肿（D对）。淋巴瘤（A错）多位于后上纵隔；神经源性肿瘤（B错）多位于后纵隔；肺癌（C错）不属于纵隔肿瘤，不会出现纵隔内类圆形阴影；心包囊肿（E错）多位于中纵隔。